地方性甲状腺肿流行地区的儿童中出现不同程度的呆、小、聋、哑、瘫等临床表现，这种病称为
A. 严重型地方性甲状腺肿
B. 先天性水俣病
C. 地方性营养不良
D. 慢性铅中毒
E. 地方性克汀病

正确答案：E。地方性克汀病

解析：本题考查地方性克汀病。地方性克汀病（E对ABCD错）原系指欧洲阿尔卑斯山区常见的一种体格发育落后、痴呆和聋哑的疾病。这是在碘缺乏地区出现的一种比较严重碘缺乏病的表现形式。患者生后即有不同程度的智力低下，体格矮小，听力障碍，神经运动障碍和甲状腺功能低下，伴有甲状腺肿。可概括为呆、小、聋、哑、瘫，每年有近千万婴儿因缺碘导致智力损伤。